胎盘早期剥离时，易发生弥散性血管内凝血的主要原因是
A. 因子Ⅻ的激活
B. 血小板因子的释放
C. 红细胞破坏
D. 组织因子入血
E. 单核吞噬细胞系统功能抑制

正确答案：D。组织因子入血

解析：组织因子入血（D对）是胎盘早期剥离等产科意外情况下，可释放大量组织因子入血，激活外源性凝血系统，启动凝血过程，易发生弥散性血管内凝血的主要原因。因子Ⅻ的激活（A错），启动内源性凝血系统是缺氧、酸中毒、抗原－抗体复合物、严重感染、 毒素等原因，均可损伤血管内皮细胞,损伤血管内皮细胞致胶原暴露产生的作用。异型输血、症疾、阵发性睡眠性血红蛋白尿等，特别是伴有较强免疫反应的急性溶血时，可引起红细胞破坏（C错）。当其吞噬功能严重障碍或由于吞噬了大量坏死组织、细菌等，单核吞噬细胞系统功能抑制（E错），可促进DIC发生。